一年之中常发生气温逆增的季节为
A. 夏季
B. 秋季
C. 冬季
D. 春季
E. 四季无差别

正确答案：C。冬季

解析：本题考查常发生气温逆增的季节。一年之中常发生气温逆增的季节，也就是气温从高到低的季节。一年四季中冬季气温最低，因此冬季（C对ABDE错）是发生气温逆增的季节。